辅助食品的添加原则错误的是
A. 从少到多
B. 由稠到稀
C. 由一种到多种
D. 由细到粗
E. 天气炎热和婴儿患病时，应暂缓添加新品种

正确答案：B。由稠到稀

解析：添加辅食的原则有：①从少到多（A对），以使婴儿有一个适应过程；②由稀到稠（B错，为本题正确答案），如从米汤开始到稀粥，再增稠到软饭；③由细到粗（D对），如从菜汁到菜泥，乳牙萌出后可试食碎菜；④由一种到多种（C对），习惯一种食物后再加另一种，不能同时添加几种。如出现消化不良应暂停喂食该种辅食，待恢复正常后，再从开始量或更小量喂起；⑤天气炎热和婴儿患病时，应暂缓添加新品种（E对）。